已知某药物口服给药存在显著的肝脏首过效应代谢作用，改用肌肉注射，药物的药动学特征变化是
A. t1/2增加，生物利用度减少
B. t1/2不变，生物利用度减少
C. t1/2不变，生物利用度增加
D. t1/2减少，生物利用度减少
E. t1/2和生物利用度均不变

正确答案：C。t1/2不变，生物利用度增加

解析：本题考查半衰期。t1/2是药物的特征参数，不因药物剂型、给药途径或剂量而改变；生物利用度是指药物被吸收进入血液循环的速度与程度，肌肉注射是将药物注入肌肉，经肌肉中的毛细血管吸收入血进入血液循环，不会产生首过效应，吸收速度较口服快（C对）。